治疗癫痫部分发作的替代药有
A. 左旋多巴
B. 氯丙嗪
C. 加巴喷丁
D. 卡马西平
E. 丙咪嗪

正确答案：C。加巴喷丁

解析：本题考查癫痫用药。部分性癫痫发作首选卡马西平、拉莫三嗪、奥卡西平、丙戊酸钠或托吡酯。替代用药包括加巴喷丁（C对）、左乙拉西坦、噻加宾、唑尼沙胺。